苦参除能清热燥湿，又能
A. 润肠通便
B. 清肺泻火
C. 化瘀止血
D. 杀虫止痒
E. 凉血消斑

正确答案：D。杀虫止痒

解析：本题考查的是苦参的功效。苦参除能清热燥湿，又能杀虫止痒（D对）。苦参：【功效】清热燥湿，杀虫止痒，利尿。决明子：【功效】清肝明目，润肠通便（A错）。三七：【功效】化瘀止血（C错），活血定痛。大青叶：【功效】清热解毒，凉血消斑（E错），利咽消肿。功效为清肺泻火（B错）的中药，2022年考试指南未明确说明。